前腭杆离开龈缘至少
A. 6mm
B. 4～6mm
C. 15mm
D. 16mm
E. 17mm

正确答案：B。4～6mm

解析：本题考查大连接体的类型与要求。前腭杆离开龈缘至少4～6mm（B对）。前腭杆：位于腭隆突之前部，腭皱襞之后部，大约位于双侧第一前磨牙之间的位置。薄而宽，厚约1mm，宽约6～8mm，离开龈缘至少4～6mm。与黏膜组织密合但无压力。侧腭杆：位于腭隆突的两侧，离开龈缘4~ 6mm。